女孩，3岁。咳嗽5天，发热2天。查体：咽红，双侧扁桃体Ⅰ度肿大，双肺可闻及较固定的中、细湿啰音。最可能的诊断是
A. 上呼吸道感染
B. 支气管肺炎
C. 支气管哮喘
D. 支气管炎
E. 毛细支气管炎

正确答案：B。支气管肺炎

解析：本例患儿咳嗽5天，发热2天，咽红，双侧扁桃体Ⅰ度肿大，说明有上呼吸道感染，双肺可闻及较固定的中、细湿啰音，最可能的诊断是支气管肺炎（B对）。上呼吸道感染（A错）局部症状有鼻塞，流涕，喷嚏，咽痛，肺部听诊一般正常。支气管哮喘（C错）咳嗽喘息呈阵发性发作，以夜间清晨为重。支气管炎（D错）双肺呼吸音粗糙。毛细支气管炎（E错）喘息和肺部哮鸣音为其突出表现。